因处方组成含蟾酥、雄黄，不宜过量或持久服用的成药是
A. 藿胆丸
B. 千柏鼻炎片
C. 六神丸
D. 清音丸
E. 鼻渊舒口服液

正确答案：C。六神丸

解析：本题考查的是六神丸的注意事项。因处方组成含蟾酥、雄黄，不宜过量或持久服用的成药是六神丸（C对）。六神丸：【注意事项】孕妇禁用。对本品过敏者禁用。过敏体质及阴虚火旺者慎用。服药期间应进食流质或半流质饮食。忌食辛辣、油腻、鱼腥食物，戒烟酒。老人、儿童及素体脾胃虚弱者慎用。因含有毒的蟾酥、雄黄、朱砂等，故不能过量服用或持久服用。外用不可入眼。有文献报道，六神丸可引起喉头水肿及药物性肝炎等。藿胆丸（A错）：【注意事项】对本品过敏者禁用。过敏体质者慎用。不宜在服药期间同时服用滋补性中药。有高血压、心脏病、肝病、糖尿病、肾病等慢性病严重者应在医师指导下服用。儿童、孕妇、哺乳期妇女、年老体弱者、脾虚便溏者应在医师指导下服用。服药3天症状无缓解者，应去医院就诊。千柏鼻炎片（B错）：【注意事项】外感风寒、肺脾气虚者慎用。高血压、青光眼患者慎用。服药期间，忌食辛辣厚味、油腻、鱼腥发物，戒烟酒。因含千里光，故不宜过量或持久服用。有文献报道，服用本品可引起肝脏损害，偶有胸痛、口干等。清音丸（D错）：【注意事项】孕妇禁用。急喉痹证属实热者慎用。服药期间，忌食辛辣油腻食物，忌烟酒。鼻渊舒口服液（E错）：【注意事项】孕妇慎用。肺脾气虚或气滞血瘀者慎用。对本品过敏者忌用。服药期间，戒烟酒，忌辛辣油腻食物。所含细辛、苍耳子均有小毒，故不宜过量或持久服用。